一妇人50岁绝经。绝经2年后经水复来,血量较多,色淡质稀,小腹空坠,神疲乏力,气短懒言,面色白,舌淡红,苔薄白,脉缓弱，其治疗最佳方剂是
A. 补中益气汤
B. 举元煎
C. 安老汤
D. 四君子汤
E. 陈夏六君子汤

正确答案：C。安老汤

解析：题干中，患者50岁绝经。绝经2年后经水复来,血量较多,色淡质稀,小腹空坠,神疲乏力,气短懒言,面色白,舌淡红,苔薄白,脉缓弱，乃属脾虚肝郁证用安老汤健脾调肝，安冲止血（C对）。补中益气汤补中益气，升阳举陷，主治脾虚气陷证（A错）。举元煎主治气虚下陷，血崩血脱，亡阳垂危等证（B错）。四君子汤具有补气，益气健脾之功效，主治脾胃气虚证（D错）。陈夏六君子补益阳气和胃化湿（E错）。